肺部叩诊呈过清音的是
A. 肺气肿
B. 大量胸腔积液
C. 气胸
D. 支气管肺炎
E. 肺空洞

正确答案：A。肺气肿

解析：肺气肿叩诊呈过清音（A对）。大量胸腔积液叩诊呈实音（B错）。气胸叩诊呈鼓音（C错）。支气管肺炎可叩诊呈浊音，在肺底部可闻及湿性和（或）干性啰音（D错）。肺空洞叩诊呈鼓音（E错）。